没有成脓的初期肿疡，治疗应首选
A. 透托法
B. 温通法
C. 清热法
D. 消法
E. 补托法

正确答案：D。消法

解析：消法以祛邪为主，并针对引起感染的不同原因和表现特点具体运用清热解毒、活血化瘀、软坚散结、祛风解表、理气祛痰、清利湿热、通里攻下等治法，适用于尚未成脓的初期肿疡（D对）。透托法（A错）用于毒气虽盛而正气未衰者。温通法（B错）为治疗虚寒阴证的代表治法。清热法（C错）用于热毒之证。补托法（E错）适用于正虚毒盛，不能托毒外达之虚证。